阳虚日久，导致阴气化生不足反映的阴阳关系是
A. 互根互用
B. 阴阳转化
C. 阴阳消长
D. 阴阳互藏
E. 对立相反

正确答案：A。互根互用

解析：该题考查阴阳学说的基本内容，注意区别，理解记忆。如果人体阴阳之间的互资互用关系失常，就会出现“阳损及阴”或“阴损及阳”的病理变化（A对）。阴阳转化，指事物的总体属性，在一定条件下可以向其相反的方向转化，如“重阴必阳，重阳必阴”、“寒极生热，热极生寒”（B错）。阴阳消长，指对立互根的阴阳双方不是一成不变的，而是处于不断的增长和消减的变化之中。阴阳双方在彼此消长的运动过程中保持着动态平衡，互消互长（C错）。阴阳互藏，指相互对立的阴阳双方中的任何一方都包含着另一方，即阴中有阳，阳中有阴（D错）。阴阳对立，指属性相反的阴阳双方在一个统一体中的相互斗争、相互制约和相互排斥。如果阴阳之间对立制约关系失调，表现为制约太过或制约不及（E错）。